以下哪种属于资源分配适宜
A. 卫生服务需要量大，卫生资源不足，卫生服务利用率高
B. 卫生服务需要量大，卫生资源充分，卫生服务利用率低
C. 资源充分，医疗服务需要低，卫生服务利用充分
D. 资源充足，利用良好，人群卫生服务需要量大，三者之间保持平衡
E. 卫生服务需要量低，资源充分，卫生服务利用低，卫生资源投入过度

正确答案：D。资源充足，利用良好，人群卫生服务需要量大，三者之间保持平衡

解析：本题考查资源分配适宜。资源分配适宜是指人群卫生服务需要量大，卫生资源投入充足，卫生服务利用量大，三者之间在高水平状态下保持相对平衡（D对ABCE错）。